对膈神经的描述，错误的是
A. 膈神经由第3~5颈神经前支组成
B. 为运动性神经，支配膈肌的运动
C. 膈神经经前斜角肌前面下行
D. 与心包、膈血管伴行
E. 经锁骨下动、静脉之间下行入胸腔

正确答案：B。为运动性神经，支配膈肌的运动

解析：膈神经由第3~5颈神经前支组成（A对），起初在前斜角肌上端的外侧下行（C对），继而沿该肌前面下降至其内侧，在锁骨下动、静脉之间经胸廓上口进入胸腔（E对），入胸腔后有心包膈血管与其伴行（D对），经由肺根前方，在纵隔胸膜与心包之间下行到达膈肌，最后于中心腱附近穿入膈肌纤维中。膈神经为混合性神经（B错，为本题正确选项），运动纤维支配膈肌的运动，感觉纤维分布于胸膜、心包以及膈肌下面的部分腹膜。